女，33岁。现左乳房包块10天，无不适症状。查体：乳房视诊无异常，左乳房外上象限可触及1.5cm×1.5cm包块，质硬，活动度良好，左腋窝未触及肿大淋巴结。钼靶X线片检查示1.5cm×lcm密度增高影，周边有小毛刺，中央可见聚集细小钙化点。准备手术治疗。以下可选择的术式中，必须在术后放疗的是
A. 保留胸大、小肌的改良根治术
B. 全乳房切除术
C. 保留胸大肌的改良根治术
D. 乳腺癌根治术
E. 保留乳房的乳腺切除术

正确答案：E。保留乳房的乳腺切除术

解析：青年女性患者，左乳房包块。体查：左乳外上象限（乳腺癌好发部位）可及质硬、粗糙的包块（乳腺癌常见临床表现）。钼靶X线片示：密度增高肿块，周边有小毛刺，中央可见聚集细小钙化点（乳腺癌典型X线表现）。综合该患者病史、体查及影像学检查，诊断考虑乳腺癌。保留乳房的乳腺切除术（E对）仅完整切除了肿块，并清除了腋淋巴结，为减少复发，术后须用超高压放射线照射乳腺部及内乳、锁骨上区。全乳房切除术（B错）后可根据病人年龄、疾病分期分类等情况，决定是否应用放疗。保留胸大、小肌的改良根治术（A错）、保留胸大肌的改良根治术（C错）、乳腺癌根治术（D错）均切除了全部乳房，术后是否接受放疗须根据患者有无放疗指征。